人类病毒性心肌炎的重要病原体是
A. 炭疽芽胞杆菌
B. 溶脲脲原体
C. 柯萨奇B组病毒
D. 伯氏球螺旋体
E. 汉坦病毒

正确答案：C。柯萨奇B组病毒

解析：人类病毒性心肌炎的重要病原体是柯萨奇B组病毒（C对），引起心肌炎的常见病毒除了柯萨奇B组病毒外，还有脊髓灰质炎病毒、孤儿病毒等（八版内科学P282）。炭疽芽胞杆菌（A错）引起炭疽病（P158）。溶脲脲原体（B错）亦称解脲脲原体，为条件致病菌，引起非淋菌性尿道炎、尿路结石等（P181）。伯氏球螺旋体（伯道疏螺旋体）（D错）可致莱姆病（P205）。汉坦病毒（E错）可致肾综合征出血热、汉坦病毒肺综合征（P286表30-1）。